正态分布曲线形状与下列哪项有关
A. 均数
B. 标准差
C. 标准误
D. 中位数
E. 方差

正确答案：B。标准差

解析：正态分布曲线形状与标准差有关，标准差越大曲线越低平，标准差越小，曲线越陡峭。掌握“定量资料的统计描述和推断”知识点。